头面部浅感觉传导路的第二级神经元在
A. 三叉神经节
B. 三叉神经脑桥核和脊束核
C. 三叉神经中脑核
D. 丘脑腹后内侧核
E. 无

正确答案：B。三叉神经脑桥核和脊束核

解析：头面部浅感觉传导路第 1 级神经元为三叉神经节（A错），第 2 级神经元的胞体在三叉神经脑桥核和脊束核（B对），第 3 级神经元的胞体在背侧丘脑的腹后内侧核（D错），三叉神经中脑核（C错）位于中脑导水管周围灰质的外侧边缘和菱形窝上部室底灰质的外侧缘。